生物碱的沉淀试剂有
A. 碘化铋钾
B. 碘化汞钾
C. 硅钨酸
D. 浓硫酸
E. 浓盐酸

正确答案：A、B、C。碘化铋钾；碘化汞钾；硅钨酸

解析：本题考查的是生物碱的沉淀反应。生物碱的沉淀试剂有碘化铋钾（A对）、碘化汞钾（B对）、硅钨酸（C对）。大多数生物碱在酸水或稀醇中与某些试剂反应生成难溶于水的络合物或复盐，这一反应称为生物碱沉淀反应，这些试剂称为生物碱沉淀试剂。常用的生物碱沉淀试剂有碘化铋钾试剂、碘化汞钾试剂、碘-碘化钾试剂、硅钨酸试剂、饱和苦味酸试剂、雷氏铵盐试剂等。浓硫酸（D错）、浓盐酸（E错）能与某些生物碱生成的易溶于水生物碱盐。